汗证营卫失调证的主症是
A. 盗汗为主，手足心热
B. 自汗或盗汗，头部和四肢为多
C. 自汗为主，头部、肩背部明显
D. 盗汗为主，遍身出汗
E. 自汗为主，汗出遍身而不温

正确答案：E。自汗为主，汗出遍身而不温

解析：汗证之营卫失调证，其临床表现为以自汗为主，或伴盗汗，汗出遍身而抚之不温，畏寒恶风，不发热，或伴有低热，精神疲倦，胃纳不振，舌质淡红，苔薄白，脉缓，故其主症为自汗为主，汗出遍身而不温（E对）。盗汗为主，手足心热（A错）和盗汗为主，遍身出汗（D错）为汗证之气阴亏虚证的主症。自汗为主，头部、肩背部明显（C错）为汗证之肺卫不固证的主症。